电子传递中生成ATP的三个部位是
A. FMN→CoQ，Cytb→CytC，Cytaa3→O₂
B. FMN→CoQ，CoQ→Cytb，Cytaa3→O₂
C. NADH→FMN，CoQ→Cytb，Cytaa3→O₂
D. FAD→CoQ，Cytb→CytC，Cytaa3→O₂
E. FAD→CytB，Cytb→CytC，Cytaa3→O₂

正确答案：A。FMN→CoQ，Cytb→CytC，Cytaa3→O₂